关于统计表纵标目的说法，错误的是
A. 研究事物的指标
B. 纵标目又称宾辞
C. 列在表的上方
D. 表达结果与主辞呼应
E. 按其发生频率的大小顺序来排列

正确答案：E。按其发生频率的大小顺序来排列

解析：统计表的标目：有横标目和纵标目，纵标目是研究事物的指标，又称宾辞，列在表的上方，其表达结果与主辞呼应。当主辞的标志不止一个时，可将部分主辞与宾辞复合。标目的正确安排可使读者自左向右顺利阅读。掌握“统计表和统计图”知识点。